测得利多卡因的消除速度常数为0.3465h⁻¹，则它的生物半衰期为
A. 4h
B. 1.5h
C. 2.0h
D. 0.693h
E. 1h

正确答案：C。2.0h

解析：本题考查生物半衰期。生物半衰期指药物在体内的量或血药浓度降低一半所需要的时间，常以t1/2表示，单位取“时间”。计算半衰期的公式为：t1/2=0.693/k，其中k为表征药物消除过程的消除速率常数。据题目中已知条件，利多卡因的k为0.3465h⁻¹，故其生物半衰期t1/2=0.693/0.3465=2.0（h）（C对）。